患者男，50岁，颈部弥漫性肿大，边缘不清，与情绪有关，皮色如常，肿块随吞咽动作上下移动，伴急躁易怒，善太息。该病的治法
A. 疏肝解郁，化痰软坚
B. 理气解郁，化痰软坚
C. 活血化瘀，软坚散结
D. 清热解毒，养阴活血
E. 益气养阴，软坚散结

正确答案：B。理气解郁，化痰软坚

解析：根据“颈部弥漫性肿大，边缘不清”，辨为“瘿病”；根据“与情绪有关，皮色如常，肿块随吞咽动作上下移动，伴急躁易怒，善太息”，辨为“瘿病”之“气郁痰阻证”；其机理是气机郁滞，痰浊壅阻，凝结颈前，治疗时应以理气舒郁、化痰软坚、消瘿散结为主（B对）。